与左旋多巴合用治疗帕金森病的是
A. 氟西汀
B. 多奈哌齐
C. 卡比多巴
D. 舒必利
E. 碳酸锂

正确答案：C。卡比多巴

解析：本题考查联合用药。卡比多巴（C对）能够抑制外周血液里左旋多巴脱羧，使左旋多巴尽可能多地进入中枢神经系统，减少副作用，达到治疗帕金森病的目的。